关于细菌细胞结构叙述错误的是
A. 细胞壁均有肽聚糖
B. 有70S核糖体
C. 核有完整的核膜和核仁
D. L型细菌无细胞壁
E. 中介体多见于G⁺菌

正确答案：C。核有完整的核膜和核仁